噬菌体在分类上属于
A. 细菌
B. 病毒
C. 原虫
D. 支原体
E. 真菌

正确答案：B。病毒

解析：噬菌体具有病毒的生物学性状，即个体微小，结构简单。掌握“噬菌体性状及分类”知识点。